医务人员修养的根本途径和方法是以下哪项
A. 坚持学习医德的理论知识
B. 坚持持之以恒
C. 坚持自我评价
D. 追求慎独
E. 坚持医疗卫生实践

正确答案：E。坚持医疗卫生实践

解析：医务人员修养的根本途径和方法是坚持医疗卫生实践。掌握“医学道德修养”知识点。